常见的疾病是过敏性鼻炎和过敏性哮喘的反应为
A. 皮肤过敏反应
B. 消化道过敏反应
C. 呼吸道过敏反应
D. 药物过敏性休克
E. 血清病

正确答案：C。呼吸道过敏反应

解析：呼吸道过敏反应：常因吸入花粉、尘螨、真菌和毛屑等变应原或感染呼吸道病原微生物引起。常见的疾病是过敏性鼻炎和过敏性哮喘。过敏性鼻炎也称花粉症，因反复吸入树粉或花粉引起，发病有明显的季节性和地区性，抗组胺药能显著控制其临床症状。过敏性哮喘有早期和晚期反应两种类型。掌握“概述及Ⅰ型超敏反应”知识点。